对淋病奈瑟菌叙述错误的是
A. 为G⁻双球菌
B. 菌毛为主要致病物质
C. 分离培养用巧克力血琼脂平板
D. 可引起淋病和新生儿脓漏眼
E. 抵抗力强

正确答案：E。抵抗力强

解析：淋病奈瑟球菌俗称淋球菌，是引起人类泌尿生殖系统黏膜化脓性感染（淋病）的病原菌，也可引起新生儿淋球菌性结膜炎。为革兰染色阴性球菌，大多有菌毛，无鞭毛，不形成芽胞，无荚膜。其菌毛有黏附作用且抗吞噬，故为主要致病物质。培养特性为专性需氧，要求为巧克力（色）血琼脂平板为适应培养环境。但是抵抗力弱，对冷热干燥和消毒剂极度敏感。掌握“肠球菌属及奈瑟菌属”知识点。